鹿茸的使用注意事项有
A. 虚寒崩漏下血者忌服
B. 血热出血者忌服
C. 阴虚阳亢者忌服
D. 阴疽内陷者忌服
E. 痰火内盛者忌服

正确答案：B、C、E。血热出血者忌服；阴虚阳亢者忌服；痰火内盛者忌服

解析：本题考查的是鹿茸的使用注意。鹿茸的使用注意事项有血热出血者忌服（B对）、阴虚阳亢者忌服（C对）、痰火内盛者忌服（E对）。鹿茸【使用注意】本品温热峻烈，故阴虚阳亢、实热、痰火内盛、血热出血及外感热病者忌服。宜从小剂量开始，逐渐加量，以免伤阴动血。【主治病证】（1）肾阳不足之阳痿滑精，宫冷不孕。（2）精血虚亏之筋骨无力、神疲羸瘦、眩晕耳鸣，小儿骨软行迟、囟门不合。（3）妇女冲任虚寒、带脉不固之崩漏、带下过多。（4）阴疽内陷（D错，疮疡久溃不敛。